当右侧内囊膝部损伤时，面肌瘫痪的部位是
A. 左侧面部睑裂以下
B. 左侧面部睑裂以上
C. 右侧面部睑裂以上
D. 右侧面部睑裂以下
E. 左侧面部全部表情肌

正确答案：A。左侧面部睑裂以下

解析：当右侧内囊膝部损伤时，面肌瘫痪的部位是左侧面部睑裂以下